患者，女，22岁，未婚。月经2〜3个月一行，量少色淡，质清稀，时有小腹冷痛，喜热喜按。伴有面色少华，小便清长，便溏，腰酸乏力，四肢欠温，舌淡，苔薄白，脉沉迟无力。治疗应首选
A. 八珍益母丸
B. 十全大补丸
C. 艾附暖宫丸
D. 大补元煎
E. 肾气丸

正确答案：C。艾附暖宫丸

解析：题中患者月经2〜3个月一行，故诊断为月经后期。阳气不足，阴寒内盛，不能温养脏腑，气血生化不足，气虚血少，冲任不充，血海满溢延迟，故月经2〜3个月一行。阳虚血失温煦，故经色淡，质清稀，阳虚不能温煦子宫，故小腹冷痛，喜热喜按，阳虚肾气不足，外府失养，故腰酸无力，小便清长，大便稀溏，舌淡，苔薄白，脉沉迟无力均为阳虚失煦，不能生血行血，血脉不充之象，故辨为虚寒证，治宜扶阳祛寒调经。八珍益母丸功能补气血，调月经，主治气虚两虚所致的月经不调（A错）。十全大补丸功能温补气血，主治气血两虚证（B错）。艾附暖宫丸功能理气补血，暖宫调经，可用于治疗月经后期虚寒证（C对）。大补元煎功能救本培元，大补气血，为月经后期血虚证的选方（D错）。肾气丸功能补肾助阳，主治肾阳不足证（E错）。